听小骨叙述错误的是
A. 位于鼓室与外耳道之间
B. 与外耳道底相垂直
C. 锤骨柄末端附于鼓膜脐
D. 镫骨底连于蜗窗
E. 砧骨与锤骨、镫骨分别构成关节

正确答案：D。镫骨底连于蜗窗

解析：听小骨由锤骨、砧骨和镫骨组成，锤骨柄末端附着于鼓膜脐（C对），镫骨底封闭前庭窗（D错，为本题正确答案），它们在鼓膜与前庭窗之间以关节和韧带连结成听小骨链（E对）。